应用一种筛选乳腺癌的试验，检查经活检证实患有乳腺癌的1000名妇女和未患乳腺癌的1000名妇女，检查结果患癌组中有900名得阳性结果，未患癌组中有100名阳性，该试验筛选工作阳性预测值是
A. 0.9
B. 0.1
C. 0.25
D. 0.3
E. 0.12

正确答案：A。0.9

解析：本题考查阳性预测值的计算。阳性预测值是指筛检发现的阳性者中患目标疾病的人所占的比例。根据公式，可计算出阳性预测值＝TP/（FP＋TP）＝900/1000×100%＝90%（A对BCDE错）。